伞形花内酯的结构类型是
A. 异香豆素类
B. 简单香豆素类
C. 呋喃香豆素类
D. 吡喃香豆素类
E. 其他香豆素类

正确答案：B。简单香豆素类

解析：本题考查的是香豆素的结构类型。伞形花内酯的结构类型是简单香豆素类（B对）。香豆素是邻羟基桂皮酸的内酯，广泛分布于高等植物中，尤其以芸香科和伞形科为多见，少数发现于动物和微生物中。在植物体内，它们往往以游离状态或与糖结合成苷的形式存在。香豆素分可为五大类，即简单香豆素类、呋喃香豆素类、吡喃香豆素类、异香豆素类及其他香豆素类。（一）简单香豆素类：这类是指仅在苯环有取代基的香豆素类。如伞形花内酯、茵芋苷。（二）呋喃香豆素类（C错）：呋喃香豆素结构中的呋喃环往往是由香豆素母核上所存在的异戊烯基与其邻位的酚羟基环合而成的，成环后有时伴随着失去3个碳原子（丙酮）的变化。1.6，7-呋喃骈香豆素型（线型）：此型以补骨脂内酯为代表，又称补骨脂内酯型。例如香柑内酯、花椒毒内酯、欧前胡内酯、紫花前胡内酯等。2.7，8-呋喃骈香豆素型（角型）：此型以白芷内酯为代表。白芷内酯又名异补骨脂内酯，故又称异补骨脂内酯型。如异香柑内酯、茴芹内酯。（三）吡喃香豆素类（D错）：香豆素C-6或C-8位异戊烯基与邻酚羟基环合而成2，2-二甲基-α-吡喃环结构，形成吡喃香豆素。1.6，7-吡喃骈香豆素（线型）：此型以花椒内酯为代表，如美花椒内酯。2.7，8-吡喃骈香豆素（角型）：此型以邪蒿内酯为代表，如沙米丁和维斯纳丁。3.其他吡喃香豆素：5，6-吡喃骈香豆素如别美花椒内酯；双吡喃香豆素如狄佩它妥内酯。（四）异香豆素类（A错）：异香豆素是香豆素的异构体，在植物中存在的多数为二氢异香豆素的衍生物，其代表化合物如茵陈炔内酯、仙鹤草内酯等。（五）其他香豆素类（E错）：是指α-吡喃酮环上有取代基的香豆素，C-3，C-4上常有苯基、羟基、异戊烯基等取代，如沙葛内酯、黄檀内酯等。另外，香豆素类成分中也发现二聚体和三聚体形式。如kotamin。